男性，42岁。3天来右上后磨牙痛重，冷热加剧，夜间痛而来就诊。近1年多来，右上磨牙进食时咬到某特定位置时出现撕裂样痛，冷热敏感，平时咬物不适。检查：16咬合面似有近远中方向越过边缘嵴的细裂纹，颊尖高陡，无龋洞，不松动，叩痛（+）。最可能的诊断是
A. 可复性牙髓炎
B. 急性牙髓炎
C. 慢性牙髓炎急性发作
D. 急性根尖周炎
E. 慢性根尖周炎

正确答案：C。慢性牙髓炎急性发作

解析：本题考查隐裂。因为患者牙痛的病史长达1年多，3天前右上后磨牙开始痛重，冷热加剧，夜间痛而来就诊，检查叩痛（+），表明患牙的诊断应是慢性牙髓炎急性发作（C对）。